张某，男，35岁。患脱疽2年，目前左小腿足趾紫红，下垂时更甚，抬高则见苍白，足背毳毛脱落，皮肤、肌肉萎缩，趾甲变厚，趺阳脉搏动消失，患肢持久性静止痛，尤以夜间较甚，舌紫暗苔薄白，脉沉细。治疗应首选
A. 阳和汤
B. 顾步汤
C. 四妙勇安汤
D. 桃红四物汤
E. 独活寄生汤

正确答案：D。桃红四物汤

解析：瘀血阻于血脉，血液运行不畅，则见左小腿足趾紫红，趺阳脉搏动消失，瘀血不去，新血不生，则见足背毳毛脱落，皮肤、肌肉萎缩，不通则痛，则见患肢持久性静止痛，尤以夜间较甚，舌紫暗薄白，脉沉细为血脉瘀阻之象（D对）。阳和汤具有温阳补血，散寒通滞之功效，适于寒湿阻络的脱疽（A错）。顾步汤具有补气养血、清热解毒之功，适于热毒伤阴证的脱疽（B错）。四妙勇安汤具有清热解毒，活血止痛之功效，适于湿热毒盛证的脱疽（C错）。独活寄生汤具有祛风湿，止痹痛，益肝肾，补气血之功效，擅长治疗痹症日久，肝肾两虚，气血不足证（E错）。